奇脉见于
A. 右心功能不全
B. 二尖瓣狭窄
C. 高血压
D. 大量心包积液
E. 主动脉瓣关闭不全

正确答案：D。大量心包积液

解析：奇脉是指吸气时脉搏明显减弱或消失，系左心室搏血量减少所致。大量心包积液（D对）时，吸气时一方面由于右心舒张受限，回心血量减少而影响右心排血量，右心室排入肺循环的血量减少；另一方面肺循环受到吸气时胸腔负压的影响，肺血管扩张，致使肺循环回流入左心房的血量减少，因而左心室排血减少，造成脉搏减弱。右心功能不全（A错）、二尖瓣狭窄（B错）、高血压（C错）和主动脉瓣关闭不全（E错）的脉波受呼吸影响不大，不会产生奇脉。